甲是药品零售连锁企业所属门店，经营类别：处方药、甲类非处方药、乙类非处方药，经营范围：第二类精神药品、生物制品、化学药、中成药、中药饮片。乙是药品零售企业，经营类别：处方药、甲类非处方药、乙类非处方药，经营范围：生物制品、化学药、中成药。丙是药品零售企业，经营类别：乙类非处方药，经营范围：生物制品、化学药、中成药。根据药品监督管理法规，结合题目提供的信息，关于药品零售行为的说法，正确的是
A. 丙在其经营场所内四处张贴，并向入店的每名消费者免费发放某乙类非处方药的广告宣传图片，该广告已经有关监督管理部门批准，宣传图片与批准内容一致
B. 甲与某中药饮片生产企业签订委托销售合同，销售该中药饮片生产企业生产的中药配方颗粒
C. 甲的驻店执业药师经审核处方并查验个人消费者身份证信息（2005年出生）后，将艾司唑仑片凭处方进行了销售
D. 乙营业期间，某个人消费者入店欲购买某甲类非处方药，药学技术人员经查询店内的该药品有效期已不足三天，并将有关信息提醒告知对方，表示可以做拆零销售，个人消费者表示接受拆零销售，药学技术人员在收银台对该药品拆零后向个人消费者进行了销售

正确答案：A。丙在其经营场所内四处张贴，并向入店的每名消费者免费发放某乙类非处方药的广告宣传图片，该广告已经有关监督管理部门批准，宣传图片与批准内容一致

解析：本题考查的是非处方药的广告管理。甲是药品零售连锁企业所属门店，经营类别：处方药、甲类非处方药、乙类非处方药，经营范围：第二类精神药品、生物制品、化学药、中成药、中药饮片。乙是药品零售企业，经营类别：处方药、甲类非处方药、乙类非处方药，经营范围：生物制品、化学药、中成药。丙是药品零售企业，经营类别：乙类非处方药，经营范围：生物制品、化学药、中成药。根据药品监督管理法规，结合题目提供的信息，关于药品零售行为的说法，正确的是丙在其经营场所内四处张贴，并向入店的每名消费者免费发放某乙类非处方药的广告宣传图片，该广告已经有关监督管理部门批准，宣传图片与批准内容一致（A对）。非处方药可以在大众媒介上进行广告宣传，但广告内容必须经过审查、批准，不能任意夸大或擅自篡改。药品上市许可持有人自行销售药品的，应当具备本法第五十二条规定的条件；委托销售的，应当委托符合条件的药品经营企业（B错）。药品上市许可持有人和受托经营企业应当签订委托协议，并严格履行协议约定的义务。第二类精神药品零售企业不得向未成年人销售第二类精神药品（C错）。在难以确定购药者是否为未成年人的情况下，可查验购药者身份证明。发放距失效期短于三个月的药品时应向患者说明药品的效期情况，叮嘱其及时服用，不要超过效期保存。遇所调剂、发放的药品距有效期短于患者处方上表示的用药时间时，应拒绝调剂、发药（D错）。